男，45岁。胃镜检查提示十二指肠球部溃疡，经药物治疗3个月仍反复发作。行胃大部切除毕Ⅱ式吻合术。术后并发症属于远期并发症的是
A. 输入襻梗阻
B. 早期倾倒综合征
C. 输出襻梗阻
D. 胃排空障碍
E. 十二指肠残端破裂

正确答案：B。早期倾倒综合征

解析：胃十二指肠溃疡手术后的并发症分为早期并发症和远期并发症，早期并发症多术中操作不当或术前准备不足有关，远期并发症多因手术导致的解剖、生理改变造成对机体的扰乱所致。术后早期并发症包括：1.术后出血；2.术后胃瘫（表现为以胃排空障碍（D错）为主的综合征）；3.术后胃肠壁缺血坏死、吻合口破裂或漏；4.十二指肠残端破裂（E错）；5.术后肠梗阻（包括输入袢梗阻（A错）、输出袢梗阻（C错）和吻合口梗阻）。术后远期并发症包括：1.倾倒综合征（分为早期倾倒综合征（B对）和远期倾倒综合征）；2.碱性反流性胃炎；3.溃疡复发；4.营养性并发症；5.残胃癌。